发生于残根、锐利的牙尖引起的舌及颊黏膜癌，说明与哪项致病因素有比较密切的关系
A. 物理因素
B. 化学因素
C. 生物因素
D. 营养因素
E. 内分泌因素

正确答案：A。物理因素

解析：物理因素：如热、损伤、紫外线、X线及其他放射性物质，以及长期慢性刺激等因素。如舌及颊黏膜癌，可发生于残根、锐利的牙尖、不良修复体等的长期、经常刺激的相应部位。掌握“口腔颌面部肿瘤的概念、临床表现、诊断”知识点。